最常见的大肠梗阻原因是
A. 结肠扭转
B. 肠粘连
C. 结肠憩室
D. 克罗恩病
E. 结肠癌

正确答案：E。结肠癌

解析：癌性梗阻为大肠梗阻的首要原因（E对）。结肠扭转是大肠梗阻第二常见的病因（A错）。肠粘连（B错）、结肠憩室（C错）、克罗恩病（D错）引起的大肠梗阻非常少见。